痛痛病重症患者常出现的症状是
A. 脊柱受压缩短变形，终日疼痛呼叫
B. 视野向心性缩小，感觉障碍
C. 氟斑牙
D. 黑脚病
E. 脱发（斑秃或全秃）

正确答案：A。脊柱受压缩短变形，终日疼痛呼叫

解析：本题考查痛痛病重症患者的症状。痛痛病是发生在日本富山县神通川流域部分镉污染地区的一种严重的环境污染性疾病，以全身剧烈疼痛为主要症状而得名，是慢性镉中毒的典型案例。痛痛病重症患者常出现的症状是脊柱受压缩短变形，终日疼痛呼叫（A对BCDE错）。